病例对照研究中，病例的选择哪项是正确的
A. 必须是住院病例
B. 必须是新确诊的病例
C. 必须是研究总体人群中的全部病例
D. 必须具有暴露于调查因素的可能性
E. 必须具有暴露于调查因素的经历

正确答案：D。必须具有暴露于调查因素的可能性